主要控制疟疾复发和传播的药物是
A. 氯喹
B. 甲硝唑
C. 乙胺嘧啶
D. 吡喹酮
E. 伯氨喹

正确答案：E。伯氨喹

解析：本题考查伯氨喹。主要控制疟疾复发和传播的药物是伯氨喹（E对）。根据作用环节，抗疟药主要分以下几类：1.主要用于控制疟疾症状的抗疟药：氯喹（A错）、青蒿素及其衍生物、奎宁、甲氟喹、咯萘啶、本芴醇。2.主要用于控制疟疾复发和传播的抗疟药：伯氨喹。3.主要用于疟疾预防的抗疟药：乙胺嘧啶（C错）、磺胺类。甲硝唑（B错）为抗阿米巴病药。吡喹酮（D错）为抗血吸虫病药。